一般骨折多长时间后，X线片可见骨性愈合
A. 1～2个月
B. 5～6个月
C. 7～9个月
D. 10～12个月
E. 12个月以上

正确答案：B。5～6个月

解析：一般需5～6个月后，在X线片上骨痂与密质骨的界限消失，看不到骨折线，此时已达到组织学上的骨性愈合。掌握“颧骨及颧弓、眼眶骨折及骨折愈合过程”知识点。